发自臂丛后束
A. 肌皮神经
B. 正中神经
C. 桡神经
D. 尺神经
E. 膈神经

正确答案：C。桡神经

解析：发自臂丛后束的为肩胛下神经、胸背神经、腋神经、桡神经（C对）。发自臂丛外侧束的为胸外侧神经、肌皮神经（A错）。发自臂丛内侧束的为胸内侧神经、尺神经（D错）。正中神经（B错）为臂丛内侧束和外侧束的内侧根和外侧根汇合而成。膈神经（E错）为颈丛的分支。